高血压病时，细动脉硬化的病理改变是
A. 动脉壁纤维化
B. 动脉壁水肿
C. 动脉壁玻璃样变性
D. 动脉壁纤维素样坏死
E. 动脉壁脂质沉着

正确答案：C。动脉壁玻璃样变性

解析：细动脉硬化是良性高血压病的主要病变特征，表现为动脉壁玻璃样变性（C对）；动脉壁纤维素样坏死（D错）是恶性高血压（P142）的特征性病理改变。高血压病时一般不发生动脉壁纤维化（A错）和动脉壁水肿（B错）。动脉壁脂质沉着（E错）是动脉粥样硬化（P132）的病理特点。